一份有关吸烟与肺癌关系的病例对照研究结果显示：x²＝12.36，P＜0.05，OR＝3.3，正确的结论是
A. 病例组肺癌患病率明显大于对照组
B. 病例组发生肺癌的可能性明显大于对照组
C. 对照组发生肺癌的可能性明显大于病例组
D. 对照组肺癌的患病率明显大于病例组
E. 不吸烟者发生肺癌的可能性明显小于吸烟者

正确答案：E。不吸烟者发生肺癌的可能性明显小于吸烟者

解析：本题考查OR值的含义。OR的含义与RR相同，均指暴露者疾病的危险性是非暴露者的多少倍。OR＞1说明暴露与疾病呈“正”关联，即暴露可增加疾病的危险性，暴露因素是疾病的危险因素；OR＜1说明暴露与疾病呈“负”关联，即暴露可降低疾病的危险性，暴露因素是保护因素；OR＝1，则表明暴露因素与疾病之间无统计学联系。根据题中条件可知吸烟与肺癌存在联系，OR＝3.3＞1，可知吸烟是肺癌的危险因素，不吸烟者发生肺癌的可能性要低于吸烟者（E对ABCD错）。